颊间隙成为感染相互扩散的通道的证据是
A. 与颞下间隙相通
B. 与颞间隙相通
C. 与咬肌间隙相通
D. 与翼下颌间隙和眶下间隙相通
E. 以上均是

正确答案：E。以上均是

解析：本题考查下颌下间隙、颊间隙感染。颊间隙借血管、颊脂垫突及脂肪结缔组织与颞下间隙（A对）、颞间隙（B对）、咬肌间隙（C对）、翼下颌间隙和眶下间隙相通（D对），成为感染相互扩散的通道。因此选E。